阿托品引起口干，心率加快，瞳孔轻度扩大的剂量
A. 0.5mg
B. 1mg
C. 2mg
D. 5mg
E. 10mg

正确答案：B。1mg

解析：1mg：口干，心率加快，瞳孔轻度扩大。掌握“阿托品”知识点。